中医谴方时正确应用中药的不同炮制品有利于提高临床疗效。关于方剂选用中药炮制品的说法，错误的是
A. 越鞠丸行气解郁，方中香附宜选用生品
B. 如圣散固涩止血，方中干姜宜烧灰存性
C. 血府逐瘀汤活血行气，方中枳壳宜选生品
D. 温脾汤温阳攻下，方中大黄宜选用生品
E. 十灰散凉血止血，方中大蓟宜选用生品

正确答案：E。十灰散凉血止血，方中大蓟宜选用生品

解析：本题考查的是中药饮片不同炮制品的正确应用。十灰散凉血止血，方中大蓟宜选炒炭（E错，为本题正确答案）。十灰散（《十药神书》）：［组成］大蓟、小蓟、荷叶、侧柏叶、茅根、茜根、山栀、大黄、牡丹皮、棕榈皮。［用法］上药各烧灰存性，研极细末，用纸包，碗盖于地上一夕，出火毒，用时先将白藕捣汁或萝卜汁磨京墨半碗，调服五钱，食后服下。［功用］凉血止血。越鞠丸（芎术丸）（《丹溪心法》）：［组成］香附、川芎、苍术、栀子、神曲各等分。［用法］为末，水丸如绿豆大（原书未著用法用量）。［功用］行气解郁（A对）。如圣散（《妇人大全良方》）：［组成］棕榈、乌梅、干姜。［用法］上药并烧灰存性，研为细末，每服二钱。乌梅酒调下，空心、食前服。［功用］固涩止血（B对）。血府逐瘀汤（《医林改错》）：［组成］桃仁、红花、当归、生地黄、川芎、赤芍、牛膝、桔梗、柴胡、枳壳、甘草。［用法］水煎服。［功用］活血化瘀，行气止痛（C对）。温脾汤（《备急千金要方》）：［组成］大黄、当归、干姜、附子、人参、芒硝、甘草。［用法］上七味，以水七升，煮取三升，分服，一日三次。［功用］攻下冷积，温补脾阳（D对）。